关于癌症病因，下述哪一项描述是错误的
A. 癌症是由多种病因诱变的
B. 机体发生癌症的内在原因有遗传因素
C. 人类癌症90%与环境因素有关，其中主要是辐射致癌和病毒致癌
D. 人类癌症90%与环境因素有关，其中主要是化学因素致癌

正确答案：C。人类癌症90%与环境因素有关，其中主要是辐射致癌和病毒致癌

解析：本题考查癌症的病因。癌症是由多种病因诱变的（A对），机体发生癌症的病因主要是环境因素和遗传因素，遗传因素属于内在原因（B对），人类癌症90%与环境因素有关，环境因素包括化学因素、物理因素、生物因素（病毒）等，其中最主要是化学因素（D对）致癌（C错，为本题正确答案）。